固有免疫应答是指机体在识别病原体以后多长时间之内做出的防御反应
A. 12小时
B. 24小时
C. 48小时
D. 72小时
E. 96小时

正确答案：E。96小时

解析：固有免疫应答是指机体在识别病原体相关的模式分子后迅速（96小时内）发生的防御反应。掌握“免疫应答基本概念、固有及适应性免疫应答”知识点。